评价非包衣片在运输过程中，互相碰撞，磨擦损失情况的限量指标是
A. 波动度
B. 相对生物利用度
C. 绝对生物利用度
D. 脆碎度
E. 絮凝度

正确答案：D。脆碎度

解析：本题考查脆碎度。评价非包衣片在运输过程中，互相碰撞，磨擦损失情况的限量指标是脆碎度（D对）。波动度（A错）是评价血药浓度波动程度的指标；相对生物利用度（B错）是试验试剂和参比试剂的AUC之比；绝对生物利用度（C错）是参比制剂的AUC与静脉注射给药的AUC之比；絮凝度（E错）是比较混悬剂絮凝程度的重要参数。